Rv5>2.5mV，STv5下移>0.05mV，Tv5倒置，电轴－22°，可诊断为
A. 左室高电压
B. 左室劳损
C. 右室肥大
D. 双室肥大
E. 左室肥大劳损

正确答案：E。左室肥大劳损